支配虹膜环形肌的是
A. N受体
B. M受体
C. α受体
D. β受体
E. 多巴胺能受体

正确答案：B。M受体